下列关于医学伦理指导原则描述错误的是
A. “防病治病”是宗旨
B. “救死扶伤”是宗旨
C. “实行社会主义人道主义”是理念
D. “全心全意”是理念
E. “为人民身心健康服务”是目标

正确答案：A。“防病治病”是宗旨

解析：医学伦理指导原则“防病治病”是手段，“救死扶伤”是宗旨，“实行社会主义人道主义”和“全心全意”是理念，“为人民身心健康服务”是目标，只有在宗旨和理念明确，手段正当并实施的前提下，才能确保目标的达成。掌握“医学伦理的指导原则”知识点。